中华医学会全科医学分会成立，标志着我国全科医学学科的诞生，其时间是
A. 1992.1
B. 1993.11
C. 1995.6
D. 1997.1
E. 1999.12

正确答案：B。1993.11